碳酸锂主要用于
A. 抑郁症
B. 躁狂症
C. 晕动病
D. 精神分裂症
E. 重症肌无力

正确答案：B。躁狂症

解析：碳酸锂主要用于抗躁狂，但有时对抑郁症也有效。掌握“丙米嗪、碳酸锂、氟西汀”知识点。